禁用于围产期妇女及12岁以下儿童的药是
A. 喹诺酮类药物
B. 青霉素类药物
C. 头孢菌素类药物
D. 中和胃酸药物
E. 抗贫血药物

正确答案：A。喹诺酮类药物